患者，女，24岁，已婚。妊娠6个半月，面目四肢浮肿，皮薄光亮，按之没指，纳呆便溏，舌胖嫩苔薄腻，脉滑缓无力。治疗应首选
A. 茯苓导水汤
B. 真武汤
C. 天仙藤散
D. 猪苓汤
E. 全生白术散

正确答案：E。全生白术散

解析：患者妊娠6个半月，浮肿遍及全身，皮薄光亮，按之没指，皮薄光亮，并伴有纳呆便溏，舌胖嫩苔薄腻等脾虚之象，故诊断为妊娠子肿脾虚证，治疗要健脾利水，故选择白术散（E对）。茯苓导水散用于妊娠肿满与子气，主要证候有喘而难卧，胀满难堪；产后浮肿，喘嗽，小便不利等症状（A错）。真武汤用于子肿肾虚证，主要证候有面浮肢肿，下肢尤甚，按之如泥；腰酸乏力下肢逆冷，小便不利等症状（B错）。天仙藤散用于子肿气滞证，主要证候有肢体肿胀，起于两足，渐延于腿，皮色不变，随按随起，胸闷胁胀，头晕胀痛等症状（C错）。猪苓汤用于水热互结证，主要证候有小便不利，发热，口渴欲饮，或心烦不寐，或兼有咳嗽、呕恶、下利，舌红苔白或微黄，脉细数等症状（D错）。